黄种人服用吗啡后的不良反应发生率高于白种人，引起这种差异的原因在影响药物作用因素中属于
A. 给药途径因素
B. 药物剂量因素
C. 精神因素
D. 给药时间因素
E. 遗传因素

正确答案：E。遗传因素

解析：本题考查影响药物的作用因素。遗传因素（E对）对药物反应的影响比较复杂，遗传基因的差异是构成药物反应差异的决定性因素，这种差异主要表现在种属差异、种族差异和个体差异，许多药物代谢酶的遗传多态性反映在种族之间。选择不同的给药途径（A错）可以影响药效；药物剂量（B错）和不良反应有关；精神因素（C错）对药物疗效有影响；给药时间（D错）对药效有影响。